一中年男性，体胖，有高血压、高脂血症病史，近来有心前区疼痛出现。如考虑心绞痛，其胸痛性质哪一种符合其特征
A. 持久的隐痛
B. 闷痛或缩窄性病
C. 针刺痛
D. 刀割样痛
E. 胸痛在活动后可减轻

正确答案：B。闷痛或缩窄性病